急诊科医生开具的盐酸肾上素注射液处方，在医疗机构内期满后的保存
A. 1年
B. 2年
C. 3年
D. 5年

正确答案：A。1年

解析：本题考查的是医疗机构药事监督管理。急诊科医生开具的盐酸肾上素注射液处方，在医疗机构内期满后的保存1年（A对）。处方由调剂处方药品的医疗机构妥善保存。普通处方、急诊处方、儿科处方保存期限为1年，医疗用毒性药品处方保存期限为2年（B错）。麻醉药品、精神药品等特殊药品处方保存期限按照特别规定。处方保存期满后，经医疗机构主要负责人批准、登记备案，方可销毁。一般来说，处方销毁申请由处方保管人向药剂科主任提出，药剂科主任填写医院《处方销毁申请表》，报医务处、业务主管院长审批，由药剂科与医务处执行销毁。处方在销毁时，必须由两位药学专业技术人员核对销毁，并建立销毁记录，销毁后要及时做好销毁登记，监销人要进行双签字。罂粟壳，必须凭盖有乡镇卫生院以上医疗机构公章的医生处方配方使用，不准生用，严禁单味零售，处方保存3年（C错）备查。